苯硫磷和马拉硫磷的联合作用经等效应线图法评定，其交点位于95%可信限下限的连线之下，可判定其作用类型为
A. 独立作用
B. 协同作用
C. 拮抗作用
D. 相加作用
E. 增强作用

正确答案：B。协同作用